不是慢性砷中毒的特异性表现的症状是
A. 皮肤色素代谢异常
B. 掌跖部皮肤角化
C. 末梢神经炎
D. 乌脚病
E. 麻痹性震颤

正确答案：E。麻痹性震颤

解析：本题考查慢性砷中毒的特异性表现的症状。地方性砷中毒是由于长期自饮用水、室内煤烟、食物等环境介质中摄入过量的砷而引起的一种生物地球化学性疾病。其特异性表现的症状有末梢神经炎（C对）、皮肤色素代谢异常（A对）、掌跖部皮肤角化（B对）、乌脚病（D对）等。麻痹性震颤（E错，为本题正确答案）不是砷中毒的特异性表现的症状。